药品监督管理部门检查发现，药品生产企业自行配送药品时，未使用封闭式运输工具运输药品，药品监督管理部门应当对该行为作出的处理是
A. 超出经营方式经营药品，依据《药品管理法》第一百一十五条对于无证经营情形给予处罚
B. 违反《药品经营质量管理规范》，依据《药品管理法》一百二十六条给予处罚
C. 违反《药品生产质量管理规范》，依据《药品管理法》第一百二十六条给予处罚
D. 违反国家药品管理规定，责令限期整改；逾期不改的，依据《药品管理法》第一百一十五条对于无证经营情形给予处罚

正确答案：B。违反《药品经营质量管理规范》，依据《药品管理法》一百二十六条给予处罚

解析：本题考查法律责任。第一百二十六条（B对）除本法另有规定的情形外，药品上市许可持有人、药品生产企业、药品经营企业、药物非临床安全性评价研究机构、药物临床试验机构等未遵守药品生产质量管理规范、药品经营质量管理规范、药物非临床研究质量管理规范、药物临床试验质量管理规范等的，责令限期改正，给予警告；逾期不改正的，处十万元以上五十万元以下的罚款；情节严重的，处五十万元以上二百万元以下的罚款，责令停产停业整顿直至吊销药品批准证明文件、药品生产许可证、药品经营许可证等，药物非临床安全性评价研究机构、药物临床试验机构等五年内不得开展药物非临床安全性评价研究、药物临床试验，对法定代表人、主要负责人、直接负责的主管人员和其他责任人员，没收违法行为发生期间自本单位所获收入，并处所获收入百分之十以上百分之五十以下的罚款，十年直至终身禁止从事药品生产经营等活动。